为避免引起新生儿循环障碍和灰婴综合征，产妇分娩前应禁用的药物是
A. 青霉素
B. 氯霉素
C. 红霉素
D. 新霉素
E. 庆大霉素

正确答案：B。氯霉素

解析：本题考查妊娠期妇女用药。为避免引起新生儿循环障碍和灰婴综合征，产妇分娩前应禁用的药物是氯霉素（B对）。分娩前应用氯霉素可引起新生儿循环障碍而致灰婴综合征。青霉素（A错）、红霉素（C错）、新霉素（D错）、庆大霉素（E错）均无灰婴综合征的不良反应。